对医德“审慎”理解有误的是
A. 用药如用兵
B. 用药如用刑
C. 慎言、慎行
D. 避开有风险的病人
E. 胆欲大而心欲小

正确答案：D。避开有风险的病人

解析：本题考查医德“审慎”。避开有风险的病人（D错，为本题的正确答案）为缺乏胆识的表现，是对审慎的错误认识。用药如用兵（A对）、用药如用刑（B对）、慎言、慎行（C对）均符合医德“审慎”的要求。胆欲大而心欲小（E对）是要求要把胆识和审慎统一起来。